成釉细胞瘤分为四型
A. 多房型、单房型、蜂窝型、局部恶性征型
B. 分叶型、多房型、卵圆型、局部恶性征型
C. 分叶型、多房型、蜂窝型、局部恶性征型
D. 多房型、单房型、卵圆型、局部恶性征型
E. 以上说法均错误

正确答案：A。多房型、单房型、蜂窝型、局部恶性征型

解析：本题考查成釉细胞瘤的病理分型。成釉细胞瘤分为四型多房型、单房型、蜂窝型、局部恶性征型（A对）。成釉细胞瘤下颌多于上颌，下颌者多见于磨牙和升支区。X线表现可分为四型：①多房型；②单房型；③蜂窝型；④局部恶性征型。